慢性铅中毒时，血和尿中ALA升高是由于
A. 琥珀酸脱氢酶受抑制
B. ALAS受抑制
C. 血红素合成酶受抑制
D. ALAD受抑制

正确答案：D。ALAD受抑制

解析：本题考查铅中毒对机体影响。当机体接触铅时，可抑制δ-氨基-γ-酮戊酸脱水酶活性（ALAD）（D对ABC错）和血红素合成酶活性，表现为尿δ-氨基-γ-酮戊酸含量和血中锌原卟啉水平增加。因此尿δ-氨基-γ-酮戊酸含量可作为反映毒作用的指标。